玉真散是
A. 含乌头类药物的中成药
B. 含生天南星的中成药
C. 含马钱子的中成药
D. 含蟾酥的中成药
E. 含生半夏的中成药

正确答案：B。含生天南星的中成药